妊娠期龈炎妇女中的牙菌斑中，检出率最高的细菌是
A. 中间普氏菌
B. 牙龈卟啉单孢菌
C. 核梭杆菌
D. 福赛拟杆菌
E. 艾肯菌

正确答案：A。中间普氏菌

解析：本题考查妊娠期龈炎的病因。妊娠期龈炎指妇女在妊娠期间，由于女性的激素水平升高，原有的牙龈慢性严症加重，使牙龈肿胀或形成龈瘤样的改变分娩后病情可自行减轻或消退。中间普氏菌（A对）在妊娠期龈炎妇女中的牙菌斑中，是检出率最高的细菌。牙龈卟啉单孢菌（B错）在慢性牙周炎的菌斑中检出率最高。核梭杆菌（C错）在急性坏死性溃疡性牙龈炎的菌斑中检出率最高。福赛斯拟杆菌（D错）在慢性根尖周炎的感染根管中检出率高。艾肯菌（E错）是人类口腔及泌尿生殖道的正常菌群，是苛养菌群中的慢速生长菌，在一定条件下可引起严重感染，主要引起细菌性心内膜炎、菌血症和混合性细菌感染。